应用食盐治疗腹痛，宜采用
A. 熏洗法
B. 气雾吸入法
C. 涂敷法
D. 敷贴法
E. 热熨法

正确答案：E。热熨法

解析：炒热食盐热敷有助于改善局部血液循环，清除病变局部的炎性因子和代谢产物，从而缓解腹痛（E对）。熏洗法是利用中药的药液及蒸气熏蒸、擦洗人体外表的一种治法，常用于发热、麻疹等病（A错）。气雾吸入法常用于治疗肺系疾病（B错）。涂敷法是将新鲜的中草药捣烂，或用药物研末加入水或醋调匀后，涂敷于体表的一种治疗方式，如贴敷腮部，脚底等（C错）。敷贴法是将药物制成软膏、药饼，或研粉撒于普通膏药上，敷贴于局部的一种外治法，常用于治疗哮喘或腹泻等（D错）。